皮质脊髓侧束
A. 支配骨骼肌随意运动
B. 起自中央后回和中央旁小叶后部
C. 下降途中，逐节止于脊髓后角
D. 全部纤维在锥体交叉处交叉至对侧
E. 无

正确答案：A。支配骨骼肌随意运动

解析：管理骨骼肌的下行纤维束分为锥体系和锥体外系，前者包括皮质脊髓束和皮质核束，皮质脊髓束又包括皮质脊髓侧束，因此皮质脊髓侧束支配骨骼肌随意运动（A对），其起于大脑皮质中央前回和其他一些皮质区域，而非起自中央后回和中央旁小叶后部（B错），中继后或直接终于同侧前角运动神经元，主要是前角外侧核，而非逐节止于脊髓后角（C错），皮质脊髓束下行至延髓锥体交叉处，大部分纤维交叉至对侧（D错），称为皮质脊髓侧束。